下列关于翼外肌的叙述，哪一项正确
A. 翼外肌位于翼腭窝
B. 翼外肌分为上下两头，上头起自翼外板的外面
C. 由于翼外肌肌纤维的方向，当髁状突颈部骨折时，常牵拉髁状突向前内方移位
D. 当左侧翼外肌出现病变，则向左偏颌时患者自觉疼痛剧烈
E. 翼外肌的肌纤维斜向后下止于翼肌粗隆

正确答案：C。由于翼外肌肌纤维的方向，当髁状突颈部骨折时，常牵拉髁状突向前内方移位

解析：翼外肌位于颞下窝。翼外肌有上、下两头。上头起于蝶骨大翼的颞下面和颞下嵴，下头起于翼外板的外侧面，向后外方走行，止于髁状突颈部的关节翼肌窝、关节囊和关节盘，功能：使下颌骨向前并降下颌骨。翼外肌功能遭到破坏，常不能作侧方运动，从而明显地降低咀嚼功能。左侧翼外肌功能受损时，右偏疼痛。掌握“咀嚼肌、颈部肌及口颌系统肌链”知识点。